适宜组织细胞生长的酸碱度为
A. 中性
B. 强碱
C. 弱酸
D. 强酸
E. 弱碱

正确答案：E。弱碱

解析：机体的组织液和血液呈弱碱性，故适宜组织细胞生长的酸碱度为弱碱（E对）。胃液由于胃酸分泌而呈酸性，尿液由于肾小管酸化功能也呈酸性。